医学模式的演变过程是
A. 神灵主义医学模式
B. 神灵主义医学模式、自然哲学的医学模式
C. 神灵主义医学模式、自然哲学的医学模式、机械论的医学模式
D. 神灵主义医学模式、自然哲学的医学模式、机械论的医学模式、生物医学模式
E. 神灵主义医学模式、自然哲学的医学模式、机械论的医学模式、生物医学模式、生物-心理-社会医学模式

正确答案：E。神灵主义医学模式、自然哲学的医学模式、机械论的医学模式、生物医学模式、生物-心理-社会医学模式